异丙肾上腺素的作用有
A. 收缩血管、舒张支气管、增加组织耗氧量
B. 收缩血管、舒张支气管、降低组织耗氧量
C. 舒张血管、舒张支气管、增加组织耗氧量
D. 舒张血管、舒张支气管、降低组织耗氧量
E. 舒张血管、收缩支气管、降低组织耗氧量

正确答案：C。舒张血管、舒张支气管、增加组织耗氧量

解析：异丙肾上腺素主要激动β受体，对β₁、β₂受体选择性很低，对α受体几乎无作用。对血管主要是激动血管β₂受体使血管舒张（AB错）；同时也可以激动支气管平滑肌β₂受体，舒张支气管平滑肌（E错）；能增加肝糖原、肌糖原分解，增加组织耗氧量（BDE错）。综上所述，异丙肾上腺素可以舒张血管、舒张支气管、增加组织耗氧量（C对）。